缩窄心包炎，多表现为
A. 脉搏短绌
B. 水冲脉
C. 奇脉
D. 颈静脉搏动
E. 交替脉

正确答案：C。奇脉

解析：缩窄心包炎，多表现为奇脉（C对），奇脉是指吸气时脉搏明显减弱或消失，系左心室搏出量减少所致。脉搏短绌（A错）指脉律绝对不规则，脉搏强弱不等，且脉率少于心率，见于房颤。水冲脉（B错）指脉搏骤起骤落，犹如潮水涨落，常见于甲状腺功能亢进症、严重贫血、脚气病、主动脉瓣关闭不全、先天性心脏病动脉导管未闭、动静脉瘘等。颈静脉搏动（D错）见于右心衰竭等。交替脉（E错）是指节律规则而强弱交替的脉搏，见于高血压心脏病、急性心肌梗死等。